下列哪项叙述不正确
A. 健康教育是有计划、有组织、有评价的教育活动
B. 健康教育就是卫生宣传
C. 健康教育是一种干预
D. 健康教育是一种社会措施
E. 健康教育是一种预防措施

正确答案：B。健康教育就是卫生宣传